春季调肝，用药当
A. 增酸省甘
B. 省酸增甘
C. 省酸增辛
D. 省酸省咸
E. 省酸收敛

正确答案：B。省酸增甘

解析：在春天，人们肝气容易过旺，从而对脾胃产生不良影响。这时就应该少吃酸性的食物，多吃甘性的食物，以此来补益人体的脾胃之气，预防各类疾病发生（B对ACDE错）。